相对数指标分析中，说法正确的是
A. 加权平均率属构成指标
B. 标化率不反映某现象发生的实际水平
C. 率可反映某事物现象内部各组成部分的比重
D. 构成比反映某事物现象发生的强度
E. 相对比必须是同类指标之比

正确答案：B。标化率不反映某现象发生的实际水平